肺下界相交于锁骨中线
A. 第5肋
B. 第6肋
C. 第7肋.
D. 第8肋
E. 第9肋

正确答案：B。第6肋

解析：在锁骨中线处肺下缘与第6肋相交（B对）。